上下前牙按常规排列，其切缘与牙尖顶与平面的关系是
A. 上颌1│1切缘落在（牙合）平面上
B. 上颌2│2切缘离开（牙合）平面1mm
C. 上颌3│3牙尖接触（牙合）平面
D. 下颌1│1切缘或牙尖顶均高于（牙合）平面1mm
E. 以上都对

正确答案：E。以上都对

解析：①上颌1|1其接触点与（牙合）堤中线一致，1|1位于中线的两侧，切缘落在（牙合）平面上，唇面与（牙合）堤唇面弧度和坡度一致（唇舌向接近直立或颈部微向舌侧倾斜），颈部微向远中倾斜，冠的旋转度与（牙合）堤一致。②上颌2|2其近中面接触1|1的远中面，切缘高于（牙合）平面约1mm，唇面与（牙合）堤弧度一致，颈部的舌向和远中向倾斜皆大于1|1，冠的旋转度与（牙合）堤唇面弧度一致。③上颌3|3其近中面接触2|2的远中面，牙尖顶接触（牙合）平面，颈部微突向唇侧且略向远中倾斜，冠的旋转度与（牙合）堤唇面弧度一致。④下颌1|1其近中面接触点与（牙合）堤中线一致，切缘高出（牙合）平面约1mm，与1|1建立正常的覆（牙合）关系，冠部的近远中向近中直立，颈部微向舌侧倾斜，冠的旋转度与（牙合）堤唇面弧度一致。掌握“全口义齿排牙及蜡型试戴”知识点。